女性，27岁。产后第4天，出现寒战高热腰痛，尿白细胞30个/HP，尿蛋白（+），并尿痛，下腹痛，肾区叩击痛，耻骨上压痛（+），血象WBC18×10⁹/L，治疗症状不缓解多长时间考虑更换抗生素
A. 72小时内无效可换药
B. 48小时内无效可换药
C. 36小时内无效可换药
D. 24小时内无效可换药
E. 8小时内无效可换药

正确答案：A。72小时内无效可换药

解析：应用抗生素治疗72小时内无效时，可考虑换药（A对）。